用于检测CTL杀伤活性的常用实验是
A. 免疫电泳
B. 流式细胞术
C. 乳酸脱氢酶释放法
D. 溶血空斑试验
E. ELISA

正确答案：C。乳酸脱氢酶释放法